《神农本草经》是现存最早的本草学专著，载药365种，包括
A. 上品120种，中品125种，下品120种
B. 上品125种，中品120种，下品120种
C. 上品120种，中品120种，下品125种
D. 上品120种，中品115种，下品130种
E. 上品115种，中品130种，下品120种

正确答案：C。上品120种，中品120种，下品125种

解析：本题考查的是《神农本草经》。《神农本草经》是现存最早的本草学专著，载药365种，包括上品120种，中品120种，下品125种（C对）。《神农本草经》：简称《本经》《本草经》《神农本草》。托名神农氏撰，约成书于东汉时期（公元25～219年），非一时一人所作。全书共3卷，序例1卷。该书序例部分，包括药物三品分类原则、君臣佐使配合、七情、四气五味、采造时月、真伪新陈、药性调剂宜忌、用药察源、毒药用法、用药大法、服药时间、大病之主等。载药365种。其分类原则是：上品120种，无毒，欲轻身益气，不老延年者；中品120种，无毒有毒斟酌其宜，欲遏病补虚羸者；下品125种，多毒，欲除寒热邪气，破积聚愈疾者。该书是最早的本草学专著，具有重要的科学价值和历史影响，为我国医药学四大经典著作之一。